牙周膜中可以吞噬变性、老化的胶原纤维，也可以合成胶原纤维的细胞是
A. 成纤维细胞
B. 牙周膜干细胞
C. 成牙骨质细胞
D. Malassez上皮剩余
E. 成骨细胞

正确答案：A。成纤维细胞

解析：成纤维细胞：与胶原纤维的合成和吸收有关。此细胞功能是合成胶原纤维，而且此细胞也可以吞噬变性、老化的胶原纤维。掌握“牙周膜”知识点。